患者，女，28岁。产后20天，右侧乳房红肿，疼痛，排乳不畅，时有畏寒发热，恶心烦渴，舌苔薄黄，脉弦。治疗除取足三里、内关、肩井穴外，还应取
A. 合谷、太冲
B. 丰隆、太冲
C. 内庭、行间
D. 梁丘、期门
E. 曲池、大椎

正确答案：D。梁丘、期门

解析：该患者乳房红肿，疼痛，排乳不畅当为乳痈，乳痈之为病，乃胃热、肝郁、火毒所致。取胃经合穴足三里、郄穴梁丘，以泻血热，泻之以清阳明之结热。期门、内关同属厥阴，能疏肝解郁、宽胸利气。肩井为治疗乳痈的经验穴，该穴为手足少阳、足阳明经和阳维脉的交会穴，对乳房肿块具有消肿、散结的功效（D对）。合谷较之于梁丘，泻血热之力差，太冲可用肝郁较明显的患者（A错）。丰隆化痰力强，但无泄热之功（B错）。内庭可用于胃热明显时，但行间无治乳痈之功（C错）。曲池、大椎均可泻热，但少了疏肝利气之穴（E错）。